与利尿药合用治疗急性肾功能衰竭的药物是
A. 去甲肾上腺素
B. 多巴胺
C. 麻黄碱
D. 肾上腺素
E. 可乐定

正确答案：B。多巴胺

解析：本题考查多巴胺（B对）。多巴胺是非强心苷类正性肌力药，与利尿剂合用可治疗肾功能衰竭。去甲肾上腺素（A错）用于治疗急性心肌梗死、体外循环等引起的低血压。麻黄碱（C错）为拟肾上腺素药，能兴奋交感神经。肾上腺素（D错）可用于过敏性休克及支气管哮喘。可乐定（E错）是中枢性降压药。